关于哌唑嗪作用的描述，错误的是
A. α₁受体阻滞药
B. 对突触前膜α₂受体也有影响
C. 降压作用中等偏强
D. 出现"首剂现象"
E. 长期应用致水钠潴留

正确答案：B。对突触前膜α₂受体也有影响

解析：哌唑嗪对a₁受体的亲和力比a₂受体亲和力高1000倍，可选择性阻断a₁受体（A对），使小动脉和小静脉血管扩张，从而降低外周阻力，血压下降。其降压作用中等偏强（C对）。对突触前膜α₂受体几无阻断作用（B错，为本题正确答案），故在降压时无反射性心率加快与肾素分泌，对肾血流量和肾小球滤过率也无明显影响。长时间应用有降血脂作用，对糖代谢无影响。哌唑嗪可阻断膀胱和尿道平滑肌a₁受体使平滑肌松弛，可减轻前列腺增生患者排尿困难的症状。主要不良反应为"首剂现象"（D对）。主要是缓解严重的难治性患者症状，由于此药可加重体液储留，只能短期使用（E对）。